阴偏胜所形成的病理变化是
A. 实热
B. 实寒
C. 虚热
D. 虚寒
E. 真寒假热

正确答案：B。实寒

解析：阳偏盛多表现为阳热亢盛而阴液未亏或亏损不甚的实热证候（A错）。阴偏盛多表现为阴盛而阳气未虚或虚损不甚的实寒证候（B对）。阴偏衰多表现为阴液不足和滋养、宁静功能减退以及阳气相对亢盛的虚热证（C错）。阳偏衰多表现为阳气虚损不能制阴，阴相对亢盛的虚寒证（D错）。阴盛格阳是指阴寒之邪壅盛于内，逼迫阳气浮越于外的真寒假热证（E错）。